男，35岁。反复上腹痛3年，疼痛向背部放射，多在空腹及夜间出现。既往体健。日常工作紧张。查体：T36.5℃，P80次／分。R18次/分，BP120/80mmHg，双肺呼吸音清，未闻及干湿性啰音，心律齐。腹软，无压痛。最可能的诊断是
A. 胃癌
B. 十二指肠溃疡
C. 胰腺癌
D. 胃溃疡
E. 食管溃疡

正确答案：B。十二指肠溃疡

解析：35岁男性患者，日常工作紧张（大量饮酒、长期吸烟、应激等是消化性溃疡的常见诱因）。该患者反复上腹痛3年，疼痛向背部放射（消化性溃疡典型表现为上腹痛。十二指肠溃疡多发生在球部，当发生在后壁时可刺激后腹膜导致疼痛向背部放射）。疼痛多在空腹或夜间出现（十二指肠溃疡典型的节律性疼痛）。综合该患者的病史和临床变现，该患者诊断考虑为十二指肠溃疡（B对）。胃溃疡（GU）（D错）（P358）多见于中老年人，多为餐后痛，夜间痛少见。胃癌（A错）（P364）55～70岁为高发年龄段。80%的早期胃癌无症状，进展期胃癌最常见的症状是体重减轻（约60%）和上腹痛（50%），另有贫血、食欲缺乏、厌食、乏力。胰腺癌（C错）（P439）发病年龄以40～65岁多见。起病隐匿，早期无特殊症状，出现明显症状时多已进入晚期。腹痛常为持续性、进行性加剧的中上腹痛或持续腰背部剧痛。